某学校为确保健康促进学校工作顺利开展，在年初制定了健康促进学校年度专项工作计划，属于健康促进学校哪个方面的工作领域
A. 制定学校健康政策
B. 创造学校物质和社会环境
C. 密切学校和社区之间的关系
D. 提高个人健康技能
E. 提供学生卫生保健服务

正确答案：A。制定学校健康政策